保济丸的主治是
A. 风寒感冒证
B. 风热感冒证
C. 暑湿感冒证
D. 外感风寒夹湿证
E. 外感风寒、内伤食积证

正确答案：C。暑湿感冒证

解析：本题考查的是保济丸的主治。保济丸的主治是暑湿感冒证（C对）。保济丸：【主治】暑湿感冒，症见发热头痛、腹痛腹泻、恶心呕吐、肠胃不适；亦可用于晕车晕船。感冒清热颗粒：【主治】风寒感冒（A错），头痛发热，恶寒身痛，鼻流清涕，咳嗽咽干。银翘解毒丸：【主治】风热感冒（B错），症见发热、头痛、咳嗽、口干、咽喉疼痛。荆防颗粒：【主治】外感风寒挟湿所致的感冒（D错），症见头身疼痛、恶寒无汗、鼻塞流涕、咳嗽。午时茶颗粒：【主治】外感风寒、内伤食积证（E错），症见恶寒发热、头痛身楚、胸脘满闷、恶心呕吐、腹痛腹泻。